具有渗透性利尿作用的药物是
A. 氢氯噻嗪
B. 呋塞米
C. 螺内酯
D. 甘露醇
E. 氨苯蝶啶

正确答案：D。甘露醇

解析：本题考查渗透利尿药。临床上常用的渗透性利尿药物包括甘露醇（D对）及高渗性葡萄糖液。